口腔扁平苔藓好发部位依次是
A. 舌、牙龈、唇
B. 舌、唇、颊黏膜
C. 前庭沟、软腭、舌、牙龈
D. 颊黏膜及前庭沟，其次为舌、唇、牙龈
E. 颊黏膜及上唇、舌、口底、硬腭、前庭沟

正确答案：D。颊黏膜及前庭沟，其次为舌、唇、牙龈

解析：口腔扁平苔藓多见于颊黏膜及前庭沟，其次为舌、唇、牙龈。掌握“口腔扁平苔藓”知识点。